灵活、有朝气，善于适应变化的生活环境，情绪体验不深是哪种人的气质特征
A. 胆汁质
B. 多血质
C. 黏液质
D. 抑郁质
E. 其他

正确答案：B。多血质